治疗风火牙痛，除选取主穴外，应加用的腧穴是
A. 太溪、行间
B. 太溪、外关
C. 太冲、曲池
D. 太冲、阳溪
E. 外关、风池

正确答案：E。外关、风池

解析：针灸治疗牙痛总治法为祛风泻火、通络止痛，选穴以手足阳明经为主。主穴选颊车、下关、合谷。阴虚牙痛加太溪、行间（A错）。太溪有滋阴补肾之功，用于肾虚牙痛（B错）。曲池主要用于治疗上肢不遂等上肢病证、热病、腹痛吐泻等肠胃病证（C错）。阳溪主治手腕痛、头痛、耳聋等（D错）。风火牙痛加外关、风池（E对）。